心脏骤停元阳暴脱证的中医治法是
A. 益气复脉
B. 开窍醒神
C. 回阳固脱
D. 益气养阴
E. 活血通脉

正确答案：C。回阳固脱

解析：心脏骤停元阳暴脱证的机理为元阳暴脱，心神散乱，故治法宜回阳固脱（C对），方药选用温阳益气的独参汤合回阳固脱的四味回阳饮加减。益气复脉（A错）治疗心悸的气阴两虚证，方药用炙甘草汤加减；益气养阴（D错）治疗气阴两虚证，代表方为生脉散加减；活血通脉（E错），开窍醒神（B错）治疗痰蒙神窍证，代表方选用菖蒲郁金汤加减。